大鼠致畸试验中的给药时间是受精后
A. 7～16日
B. 8～16日
C. 9～16日
D. 9～17日
E. 8～17日

正确答案：A。7～16日